区域性批发企业需要就近向相邻的其他省内取得麻醉药品使用资格的医疗机构销售麻醉药品，应当经
A. 国家药品监督管理部门批准
B. 批发企业所在地省级药品监督管理部门批准
C. 医疗机构所在地省级药品监督管理部门批准
D. 批发企业所在地设区的市级药品监督管理部门批准

正确答案：B。批发企业所在地省级药品监督管理部门批准

解析：本题考查麻醉药品和精神药品购销。区域性批发企业需要就近向相邻的其他省内取得麻醉药品使用资格的医疗机构销售麻醉药品，应当经批发企业所在地省级药品监督管理部门批准（B对）。由于特殊地理位置的原因，区域性批发企业需要就近向其他省、自治区、直辖市行政区域内取得麻醉药品和第一类精神药品使用资格的医疗机构销售麻醉药品和第一类精神药品的，应当经企业所在地省（区、市）药品监督管理部门批准。